氨氯地平和氢氯噻嗪产生的相互作用可能导致
A. 降压作用增强
B. 巨幼红细胞症
C. 抗凝作用下降
D. 高血钾症
E. 肾毒性增强

正确答案：A。降压作用增强

解析：本题考查药物的相互作用。氢氯噻嗪为噻嗪类利尿药，作用机制是抑制远曲小管近端Na⁺-Cl⁻共转运子，氨氯地平为钙通道阻滞剂，两药合用产生协同作用，使氨氯地平的降压作用增强（A对）。